药物产生副作用的原因
A. 剂量过大
B. 效能较高
C. 效价较高
D. 选择性较低
E. 代谢较慢

正确答案：D。选择性较低

解析：本题考查药物产生副作用的原因。药物产生副作用的原因是选择性较低（D对）。副作用是药物固有的药理作用所产生的，由于药物作用的选择性低，药理效应涉及多个器官，当某一效应用作为治疗目的时，其他效应就成为副作用。剂量过大（A错）时会发生毒性反应。效能（B错）和效价强度（C错）反映药物的不同性质，但都针对药物的治疗作用而与副作用无关。代谢较慢（E错）说明药物消除得慢，副作用与药物代谢得快慢无关。